WHO已将下列哪种儿童常见病列为需重点防治的第三位非传染病
A. 近视
B. 沙眼
C. 龋齿
D. 肥胖
E. 蛔虫感染

正确答案：C。龋齿